功能杀虫、疗癣、止痒，一般不作内服的药是
A. 儿茶
B. 硼砂
C. 土荆皮
D. 露蜂房
E. 蛇床子

正确答案：C。土荆皮

解析：本题考查的是土荆皮的功效和使用注意。功能杀虫、疗癣、止痒，一般不作内服的药是土荆皮（C对）。土荆皮：【功效】杀虫，疗癣，止痒。【使用注意】本品有毒，一般不作内服。儿茶（A错）：【功效】收湿敛疮，生肌止血，活血止痛，清肺化痰。硼砂（B错）：【功效】外用清热解毒，内服清肺化痰。【使用注意】本品多做外用，内服宜慎。露蜂房（D错）：【功效】攻毒杀虫，祛风止痛。【使用注意】本品有毒而无补虚之功，故气血虚弱者忌服。蛇床子（E错）：【功效】燥湿祛风，杀虫止痒，温肾壮阳。【使用注意】本品性温，故阴虚火旺及下焦湿热者忌服。